询问病史的道德要求是
A. 全神贯注
B. 精确操作
C. 合理配伍
D. 镇静从容
E. 争分夺秒

正确答案：A。全神贯注

解析：询问病史对医生的道德要求是：举止端庄、态度热情；全神贯注（A对）、语言得当；耐心倾听、正确引导。药物治疗对医生的道德要求是：对症下药、剂量安全；合理配伍（C错）、细致观察；节约费用、公正分配；严守法规、接受监督。急救工作对医生的道德要求是：争分夺秒（E错），全力以赴；常备不懈，沉着冷静；集思广益，团结协作；优化技能，强化功底；人性服务，呵护心理；胆大心细，坚守慎独。